关于非处方药专有标示管理的说法，错误的是
A. 甲类非处方药为红色
B. 乙类非处方药为绿色
C. 乙类非处方药的使用说明书上专有标识可单色印刷
D. 甲类非处方药所使用的大包装可单色印刷
E. 甲类非处方药所使用的标签可单色印刷

正确答案：E。甲类非处方药所使用的标签可单色印刷

解析：本题考查的是非处方药专有标识的管理。甲类非处方药标签必须按照国家药品监督管理部门公布的色标要求印刷（E错，为本题正确答案）。非处方药专有标识的管理：非处方药专有标识是用于已列入《国家非处方药目录》，并通过药品监督管理部门审核登记的非处方药药品标签、使用说明书、内包装、外包装的专有标识，也可用作经营非处方药药品的企业指南性标志。我国非处方药专有标识图案为椭圆形背景下的OTC 3个英文字母的组合，这也是国际上对非处方药的习惯称谓。非处方药专有标识图案分为红色和绿色，红色专有标识用于甲类非处方药品（A对），绿色专有标识用于乙类非处方药品（B对）和用作指南性标志。使用非处方药专有标识时，药品的使用说明书和大包装可以单色印刷（CD对），标签和其他包装必须按照国家药品监督管理部门公布的色标要求印刷。单色印刷时，非处方药专有标识下方必须标示“甲类”或“乙类”字样。非处方药专有标识应与药品标签、使用说明书、内包装、外包装一体化印刷，其大小可根据实际需要设定，但必须醒目、清晰，并按照国家药品监督管理部门公布的坐标比例使用。非处方药药品标签、使用说明书和每个销售基本单元包装印有中文药品通用名称（商品名称）的一面（侧），其右上角是非处方药专有标识的固定位置。